何首乌的后含物是
A. 草酸钙针晶
B. 草酸钙簇晶
C. 草酸钙砂晶
D. 草酸钙方晶
E. 碳酸钙钟乳体

正确答案：B。草酸钙簇晶

解析：本题考查的是何首乌的后含物。何首乌的后含物是草酸钙簇晶（B对）。何首乌粉末特征棕色。淀粉粒众多，单粒呈类球形、盔帽形或三角状锥形，脐点呈人字状、星状、弧线状或点状，层纹不明显。草酸钙簇晶较多，直径约80μm，偶见簇晶与较大的类方形结晶合生。半夏显微鉴别粉末淀粉粒众多，单粒，脐点裂缝状、人字形或星状；稍偏心，草酸钙针晶束（A错）存在于椭圆形黏液细胞中，或随处可见，导管为螺纹或环纹。洋金花【显微鉴别】粉末花粉粒类球形或长圆形，表面有条纹状雕纹。花萼、花冠裂片边缘、花丝基部均具非腺毛。花萼、花冠薄壁细胞中有草酸钙砂晶（C错）、方晶（D错）及簇晶。穿心莲【显微鉴别】粉末上下表皮均有增大的晶细胞，内含大型螺状钟乳体（E错），较大端有脐样点痕，层纹波状。下表皮气孔直轴式，副卫细胞大小悬殊，少数为不定式。另有腺鳞和非腺毛。